T₃期多发性膀胱肿瘤治疗方法是
A. 膀胱部分切除术
B. 经尿道膀胱肿瘤切除术
C. 膀胱内灌注化疗
D. 放疗
E. 根治性膀胱全切除术

正确答案：E。根治性膀胱全切除术

解析：依据癌浸润膀胱壁的深度将膀胱肿瘤分为：Tis原位癌；Ta无浸润的乳头状癌；T1浸润黏膜固有层；T2浸润肌层；T3浸润膀胱周围脂肪组织；T4浸润前列腺、子宫、阴道及盆壁等邻近器官。其中Tis、Ta、T1称为非肌层浸润性膀胱癌，T2以上则称为肌层浸润性膀胱癌。不同临床分期膀胱癌的治疗现总结如下：Tis（原位癌）可行化疗药物或卡介苗（BCG）膀胱灌注治疗。Ta、T1期肿瘤行经尿道膀胱肿瘤电切术（TURBt），术后行膀胱灌注化疗。T2期低级别、局限的肿瘤可经尿道切除或行膀胱部分切除术。T3期低级别、单个局限、如病人不能耐受膀胱全切者可采用膀胱部分切除术；膀胱浸润性癌行根治性膀胱全切除术。T4期肌层浸润性癌常失去根治性手术机会，采用姑息性放化学治疗。故对于T3期、多发性的膀胱肿瘤，应首选根治性膀胱全切除术（E对）。